治疗指数是指
A. 比值越小就越安全
B. ED₅₀/LD₅₀
C. ED₅₀/TD₅₀
D. 比值越大，药物毒性越大
E. LD₅₀/ED₅₀

正确答案：E。LD₅₀/ED₅₀

解析：治疗指数是指半数致死量（LD₅₀）与半数有效量（ED₅₀）的比值（E对BC错），其可表示药物的安全性。比值越大，药物毒性越小，越安全（AD错）。